患者外感风热，咽喉赤肿疼痛，吞咽困难，咽干，咳嗽。治疗应首选
A. 列缺
B. 内庭
C. 太溪
D. 少商
E. 廉泉

正确答案：D。少商

解析：外感风热，外感病首先侵犯肺，而咽喉为肺的门户，故咽喉肿痛，少商为手太阴肺经的井穴，主治咽喉肿痛，鼻衄，高热，昏迷，癫狂，可清泻肺热，且少商为治疗咽喉肿痛实证的主穴（D对）。列缺主治：伤风，头痛，项强，咳嗽，气喘，咽喉肿痛，口眼歪斜，牙痛，但列缺不是井穴，治疗热病不如少商更适合，不是治疗外感热病咽喉肿痛的常用穴位（A错）。内庭能清泻阳明胃经之郁热（B错）。太溪为治疗咽喉肿痛虚症的主穴（C错）。廉泉疏导咽部气血，不能起到清热的作用（E错）。